心力衰竭时血液灌流量减少最显著的器官是
A. 皮肤
B. 肝脏
C. 骨骼肌
D. 脑
E. 肾脏

正确答案：E。肾脏

解析：心力衰竭时，交感神经系统兴奋使外周血管选择性收缩，引起全身血流重新分布，以保证重要器官如心、脑的血液供应。血液灌流量减少的器官组织包括皮肤、骨骼肌及内脏器官，尤以肾脏（E对）减少最为明显，可引起肾前性肾功能衰竭。